患者，女性，30岁，左上7残冠，已行根管治疗，现拟行冠修复保护。粘接暂时冠常用的水门汀为
A. 聚羧酸锌水门汀
B. 磷酸锌水门汀
C. 玻璃离子水门汀
D. 氢氧化钙水门汀
E. 氧化锌水门汀

正确答案：E。氧化锌水门汀

解析：本题考查粘接暂时冠常用的水门汀。暂时粘接水门汀一般为氧化锌丁香油水门汀（E对），因氧化锌丁香酚水门汀对基牙有安抚、镇痛作用，能够减轻基牙预备后的牙齿敏感。聚羧酸锌水门汀（A错）具有较好的粘接性能及对牙髓刺激性较小，常用于金属固定修复体如冠、嵌体、桥的粘接固位，还可作为深龋和银汞合金充填时的直接衬层及垫底，衬层及垫底后不必再使用磷酸锌水门汀，除此之外，该水门汀可用于儿童龋洞的充填修复。磷酸锌水门汀（B错）可用于牙体缺损的暂时性和中期充填修复，粘固嵌体、冠、桥和正畸带环，还可用于深龋洞的间接垫底以及中龋洞的直接衬层及垫底，但是深龋洞时不宜直接用该水门汀衬层及垫底。玻璃离子水门汀（C错）主要用于牙缺损的充填修复、冠、桥及正畸附件的粘固、窝洞的垫底及衬层。一些玻璃离子水门汀还可用于封闭窝沟点隙。氢氧化钙水门汀（D错）可用于间接盖髓、直接盖髓、深龋洞洞衬及根管充填。